男，23岁。头晕、乏力1个月，加重伴鼻出血3天。查体：贫血貌，全身皮肤散在出血点，浅表淋巴结未触及肿大，心肺及腹部未见异常。实验室检查：Hb75g/L，WBC1.2×10⁹/L，Plt15×10⁹/L，网织红细胞0.002。该患者可能的免疫异常是
A. CD4⁺T细胞比例降低
B. CD8⁺T细胞比例增高
C. TNF水平降低
D. 补体降低
E. γδTCR⁺T细胞比例降低

正确答案：B。CD8⁺T细胞比例增高

解析：患者青年男性，头晕乏力1月，加重伴鼻出血3天，查体：贫血貌，全身皮肤散在出血点（贫血、出血症状）；血常规检查：Hb75g/L（成年男性Hb正常值120～160g/L），WBC1.2×10⁹/L（正常4～10×10⁹/L），Plt15×10⁹/L（正常100～300×10⁹/L），网织红细胞0.002（正常0.005～0.015），提示全血细胞减少，故患者诊断为再生障碍性贫血可能性大。再障患者免疫异常主要表现为外周血及骨髓淋巴细胞比例增高，T细胞亚群失衡，T辅助细胞Ⅰ型（Th1）、CD4⁺T细胞（A错）、CD8⁺T抑制细胞（B对）和γδTCR⁺T细胞（E错）比例增高，T细胞分泌的造血负调控因子如IL2、IFN-γ、TNF明显增多（C错）。补体是存在于正常人血清和组织液中的具有酶活性的蛋白质，与机体免疫调节有关，但再障的免疫异常是骨髓造血微环境的免疫异常，主要引起免疫细胞及其分泌的造血调节因子，而对血清补体无明显影响（D错）。